不属于下丘脑的结构是
A. 乳头体
B. 灰结节
C. 外侧膝状体
D. 视交叉
E. 漏斗

正确答案：C。外侧膝状体

解析：不属于下丘脑的结构是外侧膝状体（C对），外侧膝状体属于后丘脑的结构。乳头体（A错）、灰结节（B错）、视交叉（D错）、漏斗（E错）均属于下丘脑的结构。